智商IQ的结论是“超常“，其分数为
A. 70～79
B. 80～89
C. 90～109
D. 110～130
E. ＞130

正确答案：E。＞130

解析：临床上如智商（IQ）的结果大于130分为超常，70～130分为正常，低于70分为低下。掌握“常用的心理测验及临床评定测量表”知识点。